对于疮疡溃后脓水不净，经内服外敷治疗无效而形成的瘘管和窦道，其治法是
A. 挂线法
B. 结扎法
C. 砭镰法
D. 挑治疗法
E. 针灸法

正确答案：A。挂线法

解析：挂线法是用普通丝线或药制丝线或纸裹药线或橡皮筋线等来挂断瘘管或窦道的治疗方法（A对）。结扎法又名缠扎法、是将线缠扎于病变部位与正常皮肉分界处，通过结扎，促使病变部位经络阻塞、气血不通，结扎远端的病变组织失去营养而逐渐坏死脱落，从而达到治疗目的的一种方法（B错）。砭镰法俗称飞针、是用三棱针或刀锋在疮疡患处、皮肤或黏膜上浅刺，放出少量血液，使内蕴热毒随血外泄的一种治疗方法（C错）。挑治疗法是在人体的腧穴、敏感点或一定区域内用三棱针挑破皮肤、皮下组织，挑断部分皮内纤维，通过刺激皮肤经络，使脏腑得到调理的一种治疗方法（D错）。针灸法包括针法与灸法，两者各有其适应证。在外科方面，古代多采用灸法，但近年来针法较灸法应用广泛，很多疾病均可配合针刺治疗而提高临床疗效。灸法是用药物在患处燃烧，借着药力、火力的温暖作用，可以温阳祛寒、活血散瘀、疏通经络、拔引蓄毒（E错）。